直、结肠家族型多发性腺瘤性息肉属于
A. 交界性肿瘤
B. 早期癌
C. 良性肿瘤
D. 恶性肿瘤
E. 癌前病变

正确答案：E。癌前病变

解析：直、结肠家族型多发性腺瘤性息肉病是一种常染色体显性遗传性病，如不予治疗，将不可避免地出现癌变，属于癌前病史（E对）。良性肿瘤（C错）是指分化较好，异型性小的肿瘤；恶性肿瘤（D错）是指分化不好，异型性大的肿瘤；交界性肿瘤（P95）（A错）是指组织形态和生物学行为介于良、恶性之间的肿瘤。早期癌（P209）（B错）是指癌组织浸润局限于黏膜层或黏膜下层的胃肠道癌。